既能抑制环氧合酶，又能抑制脂氧合酶的芳基乙酸类非甾体抗炎药物为
A. 双氯芬酸钠
B. 萘丁美酮
C. 布洛芬
D. 美洛昔康
E. 塞来昔布

正确答案：A。双氯芬酸钠

解析：本题考查双氯芬酸钠。双氯芬酸钠（A对）为芳基乙酸类非甾体抗炎药，可抑制环氧合酶，也可以抑制脂氧合酶。萘丁美酮（B错）属于前体药物,是通过抑制前列腺素的生物合成起到治疗效果的；布洛芬（C错）是非甾体类解热镇痛药；美洛昔康（D错）是一种非甾体类抗炎药,属于选择性COX2抑制剂；塞来昔布（E错）是新一代非甾体抗炎镇痛药,通过选择性抑制COX2来抑制前列腺素生成。